伤寒出现肝脾肿大的主要原因是
A. 单核-巨噬细胞系统增生性反应
B. 合并肝硬化
C. Ⅱ型变态反应
D. Ⅲ型变态反应
E. 中毒性肝炎

正确答案：A。单核-巨噬细胞系统增生性反应

解析：肝脾肿大主要是由于全身单核-吞噬细胞系统的炎性增生反应，镜下见以巨噬细胞为主的细胞浸润（A对）。